麻疹的发病原因是
A. 胎毒
B. 风邪
C. 胎毒加风邪
D. 胎毒加病气
E. 麻疹时邪

正确答案：E。麻疹时邪

解析：该题考查麻疹病因，理解记忆即可。麻疹发病的原因，为感受麻疹时邪（E对）。